病理解剖一女尸，发现一侧肾体积较小，表面不光滑，有数个大小不一、不规则瘢痕，切面瘢痕处质地较硬，肾盂黏膜增厚等改变，该肾最可能的病理诊断是：
A. 动脉粥样硬化梗死瘢痕
B. 慢性肾炎
C. 慢性肾盂肾炎
D. 高血压固缩肾
E. 以上都不是

正确答案：C。慢性肾盂肾炎

解析：该肾最可能的病理诊断是慢性肾盂肾炎（C对），慢性肾盂肾炎病理改变特点是：一侧或双侧肾脏体积缩小，出现不规则的瘢痕，其大小数量不等，分布不均，肾脏切面肾乳头萎缩，肾盂肾盏变形，肾盂黏膜粗糙增厚。动脉粥样硬化梗死瘢痕（A错）因斑块合并血栓形成致肾组织梗死，梗死灶机化后遗留较大凹陷瘢痕，多个瘢痕可使肾脏缩小。慢性肾炎（B错）病变特点是肉眼观，双肾体积缩小，表面呈弥漫性粒状；切面皮质变薄，皮髓质界限不清，肾盂周围脂肪增多，大体病变称为继发性颗粒，性固缩肾。高血压固缩肾（D错）双侧肾脏对称性缩小，质地变硬，肾表面凸凹不平，呈细颗粒状。切面肾皮质变薄，皮髓质界限模糊，肾盂和肾周围脂肪组织增多。